肾病综合征患者长期使用泼尼松时，用法为隔日清晨给药一次，这种给药方法的原理是
A. 利用人体糖皮质激素分泌的昼夜节律性原理
B. 利用外源性糖皮质激素的生物等效原理
C. 利用糖皮质激素的脉冲式分泌原理
D. 利用糖皮质激素与盐皮质激素互为补充的原理
E. 利用糖皮质激素逐渐减量原理

正确答案：A。利用人体糖皮质激素分泌的昼夜节律性原理

解析：本题考查泼尼松的给药原理。肾病综合征患者长期使用泼尼松时，用法为隔日清晨给药一次，这种给药方法的原理是利用人体糖皮质激素分泌的昼夜节律性原理（A对）。泼尼松属于肾上腺糖皮质激素，人体糖皮质激素的分泌具有昼夜节律性，分泌高峰期在上午8时（约450nmol/L），随后逐渐下降（下午4时约110nmol/L），午夜12时为低潮，因此临床应用外源性糖皮质激素，应该遵循内源性分泌节律进行，这样对下丘脑、垂体、肾上腺皮质抑制较轻，不良反应较少。